属于抑癌基因的是
A. Rb
B. ras
C. myc
D. erb-2
E. sis

正确答案：A。Rb